影响传染病年龄分布的主要因素是
A. 接触程度的高低
B. 身体体质的强弱
C. 潜伏期长短
D. 免疫水平的高低

正确答案：D。免疫水平的高低

解析：本题考查影响传染病年龄分布的主要因素。影响传染病年龄分布的主要因素是免疫水平的高低（D对ABC错）。